女，35岁。双手第2、3、5近端指间关节、双腕和双肘关节肿痛1年，伴晨僵1小时。查体：上述关节肿胀、压痛。实验室检查：ESR48mm/h，CRP升高。双手X线片：双手骨质疏松，第2近端指间关节可见骨质破坏。对诊断最有意义的实验室检查是
A. 血尿酸
B. 类风湿因子
C. 抗核抗体
D. 抗链“O”
E. 抗环瓜氨酸肽抗体

正确答案：E。抗环瓜氨酸肽抗体

解析：35岁女性患者（类风关好发于35～50岁女性），双手第2、3、5近端指间关节双腕和双肘关节肿痛1年（双侧小关节对称性肿痛），伴晨僵1小时（类风关的常见临床表现）。实验室检查：ESR48mm/h，CRP升高（提示存在炎症反应）。双手X线片双手骨质疏松，第2近端指间关节可见骨质破坏（类风关典型X线表现）。综合该患者的病史、体查、实验室检查及影像学检查，诊断考虑类风湿性关节炎，对诊断最有意义的实验室检查是抗环瓜氨酸肽抗体（E对）。抗环瓜氨酸肽抗体包括抗APF、AKA、filaggrin、抗CCP等抗体，诊断类风湿性关节炎敏感性及特异性均较高。类风湿因子（B错）并非类风湿性关节炎的特异性抗体，其他感染性、自身免疫性疾病及约5%的正常人亦可出现RF阳性，故其诊断价值不如抗环瓜氨酸肽抗体。血尿酸（A错）测定多用于辅助诊断高尿酸血症及痛风。抗核抗体（C错）测定多用于辅助诊断系统性红斑狼疮。抗链“O”测定多用于辅助诊断风湿热。